以下杂质检查方法所用的试剂是：炽灼残渣的检查
A. 氯化钡试液
B. 酸性氯化亚锡试液
C. 硫酸
D. 硫氰酸铵溶液
E. 硫酸肼溶液

正确答案：C。硫酸